根除幽门螺杆菌治疗后，不宜选用的复查方法是
A. ¹³C或¹⁴C尿素呼气试验
B. 血清幽门螺杆菌抗体检查
C. 组织学检查
D. 快速尿素酶试验
E. 幽门螺杆菌培养

正确答案：B。血清幽门螺杆菌抗体检查

解析：幽门螺杆菌的检测方法有非侵入性方法如¹³C或¹⁴C尿素呼气试验（A对）、血清幽门螺杆菌抗体检查和侵入性方法如组织学检查（C对）、快速尿素酶试验（D对）、幽门螺杆菌培养（E对）、粪便幽门螺杆菌抗原检测等。其中血清幽门螺杆菌抗体检查（B错，为本题正确答案）在幽门螺杆菌根除后仍可为阳性，不能作为判断幽门螺杆菌根除的检验方法，其余方法均为阴性。